男，35岁，头痛、头晕1年，1周来加重伴心悸乏力鼻出血及牙龈出血来诊。查体：血压170/110mmHg，皮肤粘膜苍白，Hb65g/L，PLTl48×10⁹/L，尿蛋白（+++），尿红细胞3～5/HP，BUN38mmol/L，Scr887μmol/L，Ccr10ml/min，肾脏B超左肾8.9×4.6×4.1cm，右肾8.7×4.4×4.1cm，双肾皮质变薄。该患者不可能出现的电解质和酸碱平衡失调是
A. 低钙血症
B. 高镁血症
C. 低钠血症
D. 低镁血症
E. 代谢性酸中毒

正确答案：D。低镁血症

解析：该患者诊断为慢性肾功能衰竭尿毒症期，常出现各种电解质代谢紊乱和酸碱平衡失调，常见的有：①由于肾脏排泄功能下降，水、钠潴留，引起稀释性低钠血症（C对）；②由于肾小管分泌H⁺障碍或HCO3⁻重吸收能力下降、酸性代谢产物排泄障碍，导致代谢性酸中毒（E对）；③由于钙摄入不足、活性维生素D缺乏、高磷血症等，导致钙缺乏，钙缺乏明显时出现低钙血症（A对）；④由于肾小球滤过率降低，肾脏排镁减少，常出现高镁血症（B对），一般不会出现低镁血症（D错，为本题正确答案）。